给水管道和污水管道埋设时，配置合理的是
A. 给水管道与污水管道交叉时，给水管道应埋设在污水管道的上面，垂直净距不得小于0.5m
B. 污水管道必须在给水管道上面通过时，给水管道应加套管，其长度距交叉点每侧2～3米
C. 给水管道与污水管道平行铺设时，垂直间距应有0.5m，水平间距不小于1米
D. 污水管道必须在给水管道上面通过时，给水管道应加套管，其长度距交叉点每侧3～5米
E. 给水管道与污水管道平行铺设时，垂直间距应有0.5m，水平间距不小于4米

正确答案：D。污水管道必须在给水管道上面通过时，给水管道应加套管，其长度距交叉点每侧3～5米

解析：本题考查给水管道和污水管道的埋设。管道的埋设应避免穿过垃圾和毒物污染区，否则应加强防护措施。给水管道与污水管道交叉时，给水管道应埋设在污水管道的上面，垂直净距不得小于0.4m（A错），如污水管道必须在给水管道上面通过时，给水管应加套管，其长度距交叉点每侧3～5m（D对B错）。如给水管与污水管平行铺设时，垂直间距应有0.5m，水平间距不小于1.5～3m（CE错）。给水管埋设深度应在当地冻结线以下，以防冻结。企事业单位自备的供水系统，不得与城市公共供水管网直接连接。